下列哪项不符合前置胎盘的表现
A. 先露下降受阻
B. 无痛性阴道流血
C. 子宫下段闻及胎盘血流音
D. 子宫张力较高，胎心音不易闻及
E. 宫底高度与孕周相符

正确答案：D。子宫张力较高，胎心音不易闻及

解析：子宫张力较高，胎心音不易闻及是胎盘早剥的特点，不是前置胎盘的特点，故D答案错误。其他四项都是前置胎盘的特点。掌握“前置胎盘”知识点。